女性，35岁。皮下结节2年，1个月来癫痫发作频繁。查体：躯干、四肢、头皮下可触及多个0.5cm✕1cm大小的圆形结节，无触痛，与周围无粘连。采集病史时，应特别注意询问
A. 癫痛的发作情况
B. 癫痫的家族史
C. 饮食卫生状况
D. 用药史
E. 风湿病史

正确答案：C。饮食卫生状况